男，26岁，水肿少尿一周。一月前上呼吸道感染史。查体：BP150/90mmHg，尿蛋白（++），RBC100-150/HP，血Hb：100g/l，血肌酐456，B超双肾体积增大，最可能的病理
A. 膜性肾病
B. 膜增生性肾小球肾炎
C. 局灶节段性肾小球肾炎
D. 系膜增生性肾小球肾炎
E. 新月体性肾小球肾炎

正确答案：E。新月体性肾小球肾炎

解析：该患者男，26岁，一月前上呼吸道感染史（新月体性肾小球肾炎病史）。出现水肿少尿一周。查体：BP150/90mmHg，尿蛋白（++），RBC100-150/HP，血Hb：100g/l，血肌酐456μmol/L，B超双肾体积增大（新月体性肾小球肾炎表现和辅助检查），所以诊断为新月体性肾小球肾炎（E对）。